乙型肝炎母婴传播，以下列哪项所生的新生儿传播慨率最高
A. HBsAg阳性母亲
B. 抗-HBs阳性母亲
C. HBeAg阳性母亲
D. 抗-HBe阳性母亲
E. HBsAg和HBeAg双阳性母亲

正确答案：E。HBsAg和HBeAg双阳性母亲